与接合有关的细菌结构是
A. 微绒毛
B. 普通菌毛
C. 性菌毛
D. 鞭毛
E. 纤毛

正确答案：C。性菌毛

解析：接合是指细菌通过接合性质粒介导和性菌毛的中空管状结构连接沟通，将遗传物质（如F质粒、R质粒或染色体DNA片段）从供体菌转入受体菌。通常带有性菌毛的细菌是雄性菌，通过性菌毛可以把质粒传给雌性菌，使受体菌获得质粒所控制的遗传性状。掌握“细菌遗传变异的物质基础及机制”知识点。